具有细胞毒作用的是
A. Tc
B. Treg
C. Th
D. Th1
E. Th2

正确答案：A。Tc